能够明确甲状腺单发结节性质的最可靠方法是
A. ECT
B. 颈部X线摄片
C. 细针穿刺细胞学检查
D. 甲状腺B超扫描
E. 颈部CT

正确答案：C。细针穿刺细胞学检查

解析：在所述五种方法中，细针穿刺细胞学检查（C对）是明确甲状腺结节性质的最可靠办法，其准确率高达80%以上（5版外科学P344）。ECT（A错）能够反映甲状腺局部及整体功能，能够发现甲状腺结节并进行良恶性鉴别，但最终确诊仍依赖活检。颈部X线摄片（B错）可显示软组织钙化、积气、气管形态等，但不用于诊断甲状腺病变。甲状腺B超扫描（D错）是甲状腺结节的首选影像学检查方法，可用于甲状腺结节的鉴别诊断，但最终确诊仍依赖活检。颈部CT（E错）能显示甲状腺的病灶数目、部位、与邻近结构关系以及有无淋巴结肿大，但并不能明确结节性质。